下列哪个因素是心身疾病的致病或诱发因素
A. 情绪因素
B. 心理社会因素
C. 环境因素
D. 遗传因素
E. 生物学因素

正确答案：B。心理社会因素